某学生寝室，共住2名女生，甲女活泼好动，每周有3～4天与同学一起打乒乓球。乙女整日课后都待在寝室看书，又喜欢吃零食，体重达100kg。甲女的行为属于
A. 日常健康行为
B. A型行为
C. 预警行为
D. C型行为
E. 不良生活方式

正确答案：A。日常健康行为